渴不多饮,身热不扬,多属
A. 阳明腑实
B. 阴虚内热
C. 湿热内蕴
D. 热入营血
E. 血瘀发热

正确答案：C。湿热内蕴

解析：渴不多饮，兼身热不扬，心中烦闷，苔黄腻者，属湿热证。因热邪伤津则口渴，体内有湿故不多饮（C对）。日晡潮热为阳明腑实证（A错）。口渴咽干，夜间尤甚，颧赤盗汗，五心烦热者，是阴虚津亏，虚火内炽的表现（B错）。渴不多饮，兼身热夜甚，心烦不寐，舌红降者，属温病营分证（D错）。口干，但欲漱水不欲咽，兼面色黧黑，或肌肤甲错者，为淤血的表现（E错）。